上腔静脉的属支是
A. 胸廓内静脉
B. 椎静脉
C. 甲状腺下静脉
D. 奇静脉
E. 锁骨下静脉

正确答案：D。奇静脉

解析：奇静脉（D对）在上腔静脉穿纤维心包之前注入，为上腔静脉的属支。